出生后第一个10年内哪个系统基本不发育
A. 淋巴系统
B. 神经系统
C. 生殖系统
D. 消化系统
E. 呼吸系统

正确答案：C。生殖系统

解析：本题考查生长发育的一般规律。生后第一个十年内，生殖系统（C对ABDE错）在青春期前处于静止状态，生殖系统外形几乎没有发展；青春期生长突增开始后生长迅猛，并通过分泌性激素，促进机体的全面发育成熟。人体各组织器官的生长模式可归纳为4类，分别是一般型、神经系统型、淋巴系统型和生殖系统型。1.一般型包括全身肌肉、骨骼、脏器和血液，其生长模式大致与形态指标（身高、体重等）相同，生长期内具有两个突增高峰；2.神经系统型：脑、脊髓、视觉器官以及反映大脑大小的头围、头径等。出生时已达成人的25%，6岁时已达1200g，达到成人脑重的90%；3.淋巴系统型：胸腺、淋巴结、间质性淋巴组织等在出生后头10年生长非常迅速，12岁左右约达成人的200%，在第二个10年期间；4.生殖系统型：在童年期几乎没有发展，只在生长发育第二个突增期开始以后，才开始生长，并通过分泌性激素来促进全面发展和成熟。